人类文化的产生与发展是世代努力的结果，这指的是文化的
A. 历史性
B. 现实性
C. 渗透性
D. 继承性
E. 社会性

正确答案：A。历史性